子宫内膜结核最可靠的诊断依据是
A. 月经血结核菌培养
B. 子宫内膜病理活检
C. 宫腔镜检查
D. 子宫输卵管碘油造影
E. 盆腔X线片见孤立钙化点

正确答案：B。子宫内膜病理活检

解析：子宫内膜结核最可靠的诊断依据是子宫内膜病理活检（B对），在病理切片上找到典型结核结节，诊断即可成立。月经血结核杆菌培养（P266）（A错）难度较大，且培养周期长，不易成功培养出结核杆菌，易出现假阴性。宫腔镜检查（C错）能直接观察宫腔内有无粟粒结节；子宫输卵管碘油造影（P266）（D错）是考虑有子宫内膜结核的可能，如果要确诊子宫内膜结核均需结合病变处的活组织检查。盆腔X线片（P266）见孤立钙化点（E错）提示曾有盆腔淋巴结结核病病灶。